治疗甲状腺炎气滞痰凝证，应首选
A. 海藻玉壶汤
B. 普济消毒饮合丹栀逍遥散
C. 透脓散合仙方活命饮
D. 龙胆泻肝汤合芍药散
E. 知柏地黄汤合当归六黄汤

正确答案：A。海藻玉壶汤

解析：海藻玉壶汤具有疏肝理气、软坚散结的功效，用于甲状腺炎痰凝血瘀证（A对）。普济消毒饮与丹栀逍遥散（B错）具有清肝泻胃，解毒消肿的功效，适用于甲状腺炎肝郁胃热证。透脓散合仙方活命饮（C错）具有清热解毒，消肿排脓的功效，适用于甲状腺炎火毒炽盛证。龙胆泻肝汤合芍药散（D错）具有清肝泻火，解郁散结的功效，适用于甲状腺功能亢进肝火旺盛证。知柏地黄汤合当归六黄汤（E错）具有滋阴清热，化痰软坚的功效，适用于甲状腺功能亢进阴虚火旺证。